含氟牙膏的防龋效果有关的因素不包括
A. 基线水平
B. 牙膏的含氟浓度
C. 牙膏的生产日期
D. 牙膏的摩擦剂系统
E. 专业人员的指导下使用

正确答案：C。牙膏的生产日期

解析：与含氟牙膏的防龋效果有关的因素：①牙膏的摩擦剂系统；②牙膏的含氟浓度；③基线水平；④在专业人员的指导下使用可获得较高的防龋效果。掌握“氟的全身及局部应用”知识点。